肾上腺皮质功能不足的患者，需要补充哪种激素以缓解症状
A. 胰岛素
B. 胰高血糖素
C. 醛固酮
D. 肾上腺素
E. 糖皮质激素

正确答案：E。糖皮质激素